一般来说，釉质生长线代表釉质沉积的时间段约为
A. 7～8天
B. 5～6天
C. 6～8天
D. 4～7天
E. 5～10天

正确答案：E。5～10天

解析：釉质生长线是釉质周期性的生长速率改变所形成的间歇线，其宽度和间距因发育状况变化而不等，较横纹的间距大得多，约代表5～10天釉质沉积的速度。掌握“牙釉质”知识点。